影响药物透过生物膜吸收的中西药联用药组是
A. 乌梅与阿司匹林
B. 乌贝散与头孢立定
C. 石膏与四环素
D. 麻黄与呋喃唑酮
E. 大黄与利福平

正确答案：E。大黄与利福平

解析：本题考查的是中西药联用的药物相互作用。影响药物透过生物膜吸收的中西药联用药组是大黄与利福平（E对）。中药中的某些成分如鞣质、药用炭、生物碱、果胶及金属离子等易与西药结合或吸附，特别是以固体形式口服的西药，可导致某些药物作用下降。含鞣质较多的中药有大黄、虎杖、五倍子、石榴皮等，因此中成药牛黄解毒片（丸）、麻仁丸、七厘散等不宜与口服的红霉素、士的宁、利福平等同用，因为鞣质具有吸附作用，使这些西药透过生物膜的吸收量减少。乌梅与阿司匹林（A错）联用可减少排泄。含有机酸成分的中药，如乌梅、山茱萸、陈皮、木瓜、川芎、青皮、山楂、女贞子等与磺胺类药物、利福平、阿司匹林等酸性药物合用时，因尿液酸化，可使磺胺类药物的溶解性降低，导致尿中析出结晶，引起结晶尿或血尿，增加磺胺类药物的肾毒性；可使利福平和阿司匹林的排泄减少，加重肾脏的毒副作用。乌贝散与头孢立定（B错）联用可增加排泄。碱性药物由于与酸性药物发生相互作用，可大大加快药物排泄速度，导致药效降低，甚至失去治疗作用。碱性中药如煅牡蛎、煅龙骨、红灵散、女金丹、痧气散、乌贝散、陈香露白露片等，可碱化尿液，与酸性药物诺氟沙星、呋喃妥因、吲哚美辛、头孢类抗生素等联用时，增加酸性西药的解离，排泄加快，使作用时间和作用强度降低。石膏与四环素（C错）联用可影响药物在胃肠道的稳定。中成药中含有某些重金属或金属离子，当与一些具有还原性的西药配伍使用时，会生成不溶性螯合物，影响药物在胃肠道的稳定性，甚至造成毒副反应。四环素类抗生素是多羟基氢化并苯衍生物，在与含金属离子如Ca²⁺、Fe²⁺、Fe³⁺、Al³⁺、Mg²⁺等的中药如石膏、海螵蛸、自然铜、赤石脂、滑石、明矾等以及含有以上成分的中成药，如牛黄解毒片等同服时，酰胺基和多个酚羟基能与上述金属离子发生螯合反应，形成溶解度小、不易被胃肠道吸收的金属螯合物，从而降低四环素在胃肠道的吸收。麻黄与呋喃唑酮（D错）联用具有协同增效作用。许多中西药联用后，均能使疗效提高，有时很显著地呈现协同作用，如黄连、黄柏与四环素、呋喃唑酮（痢特灵）、磺胺甲基异唑，治疗痢疾、细菌性腹泻有协同作用，常使疗效成倍提高。